检查乳房的最佳时间是
A. 经前
B. 经后3天
C. 经后7～10天
D. 经后2周
E. 经后3周

正确答案：C。经后7～10天

解析：乳房检查是检查乳房是否发生异变的常规检查。检查乳房的最佳时间一般是月经结束后的第7～10天左右，因为此时雌激素对乳腺的影响最小，乳房处于相对静止状态，乳腺的病变或异常容易被发现，而绝经后的女性则可随意选择检查乳房的时间（C对）。